急性CO中毒急救不正确的是
A. 立即开窗通风
B. 脱离中毒现场
C. 吸氧
D. 保持呼吸道通畅
E. 给解磷定解毒

正确答案：E。给解磷定解毒